初产妇，妊娠39周，骨盆各径线为：对角径13cm，坐骨棘间径9.5cm，坐骨结节间径7cm，耻骨弓角度80°。本例估计胎儿体重3700g，其分娩方式应为
A. 等待自然分娩
B. 试产
C. 剖宫产
D. 产钳助产
E. 胎头吸引

正确答案：C。剖宫产

解析：本例患者对角径13cm（正常值为12.5～13cm，骨盆入口平面正常），坐骨棘间径9.5cm，考虑中骨盆平面狭窄（坐骨棘间径≤10cm，考虑为中骨盆平面狭窄）；坐骨结节间径7cm，考虑骨盆出口平面狭窄（坐骨结节间径≤7.5cm，考虑为骨盆出口平面狭窄），且耻骨弓角度＜90°，故本例可考虑诊断为漏斗骨盆（漏斗骨盆的骨盆入口平面正常，中骨盆和骨盆出口平面均狭窄，且耻骨弓角度＜90°）。骨盆出口平面狭窄不应进行阴道试产（B错），常用坐骨结节间径与出口后矢状径之和估计出口大小，若两者之和＞15cm，足月胎儿（妊娠39周，胎儿体重3700g）不易经阴道分娩（A错），应行剖宫产术（C对）结束分娩。产钳助产（D错）、胎头吸引（E错）都是阴道分娩的辅助方式。